属于噻唑烷二酮类胰岛素分泌促进剂的降血糖药物是
A. 那格列奈
B. 盐酸二甲双胍
C. 阿卡波糖
D. 格列吡嗪
E. 盐酸吡格列酮

正确答案：E。盐酸吡格列酮

解析：本题考查盐酸罗格列酮。盐酸罗格列酮（E对）是属于噻唑烷类胰岛素分泌促进剂的降糖药物。那格列奈（A错）是D-苯丙氨酸衍生物。二甲双胍（B错）是双胍类胰岛素增敏剂。阿卡波糖（C错）为α-葡萄糖苷酶抑制剂。格列吡嗪（D错）为磺酰脲类胰岛素分泌促进剂。